年轻恒牙髓室有炎症或坏死时，髓室内部分髓组织或根管髓可能仍是活的原因是
A. 年轻恒牙牙髓组织疏松，血运丰富
B. 髓细胞和未分化间叶细胞较多
C. 防御和修复功能强
D. 渗出作用较弱，增生现象较显著
E. A+B+C+D

正确答案：E。A+B+C+D

解析：本题考查年轻恒牙牙髓的组织学特点。年轻恒牙牙髓组织疏松，血运丰富（A对），髓细胞和未分化间叶细胞较多（B对），为保存活髓的有利条件，但由于牙髓抵抗力强（C对），炎症也容易被局限呈慢性过程，又因牙髓组织疏松、根尖孔大、血运丰富，感染也易扩散，增生现象显著（D对），故应及时治疗。（ABCD均对，故E为本题的正确答案）。